慢性腹泻一般是指腹泻反复发作，病程超过
A. 1个月以上
B. 2个月以上
C. 3个月以上
D. 4个月以上
E. 5个月以上

正确答案：B。2个月以上

解析：本题考查慢性腹泻。慢性腹泻一般是指腹泻反复发作，病程超过2个月以上（B对ACDE错），甚至迁延数月或数年。